患者慢性心力衰竭5年，现症见心悸，气短，肢倦乏力，动则加剧，神疲咳喘，面色苍白，舌淡，脉沉细。其治法是
A. 益气温阳
B. 温补心肾
C. 补益心肺
D. 益气养阴
E. 益气活血

正确答案：C。补益心肺

解析：患者慢性心力衰竭5年，现症见心悸，气短，肢倦乏力，动则加剧，神疲咳喘，面色苍白，舌淡，脉沉细，为气虚症状，故治法为补益心肺（C对）。阳气虚弱证治法是益气温阳（A错）。心肾阳虚证治法是温补心肾（B错）。气阴两虚证治法是益气养阴（D错）。气虚血瘀证治法是益气活血（E错）。